某女，27岁。1周前因右前臂出现鲜红色皮疹，皮疹为圆形红斑，上附糠状鳞屑，自服复方青黛胶囊，每次4粒，每天3次。服药4天后出现恶心、乏力、腹胀、身黄、目黄，遂停药就诊。入院查体：体温37℃，皮肤及巩膜黄染，无肝掌及蜘蛛痣，心肺听诊未闻及异常，腹软；实验室检查：丙氨酸氨基转移酶600U/L，天门冬氨酸氨基转移酶528U/L，总胆红素98μmol/L，甲、乙丙型肝炎病毒学检查均为阴性。经询问，患者服药期间未服用其他药物及保健品，但2年前曾服用过复方青黛胶囊，也曾出现过转氨酶升高的情况。入院对症处理后，症状缓解，复查肝功能：丙氨酸氨基转移酶100U/L，天门冬氨酸氨基转移酶98U/L，总胆红素18μmol/L。执业药师对该患者肝损伤与复方青黛胶囊之间的关联性进行评价，正确的评价结果是
A. 可能无关
B. 肯定相关
C. 可能相关
D. 很可能相关
E. 无法评价

正确答案：B。肯定相关

解析：本题考查的是药品不良反应的关联性评价。1周前因右前臂出现鲜红色皮疹，皮疹为圆形红斑，上附糠状鳞屑，自服复方青黛胶囊，每次4粒，每天3次。服药4天后出现恶心、乏力、腹胀、身黄、目黄，遂停药就诊。入院查体：体温37℃，皮肤及巩膜黄染，无肝掌及蜘蛛痣，心肺听诊未闻及异常，腹软；实验室检查：丙氨酸氨基转移酶600U/L，天门冬氨酸氨基转移酶528U/L，总胆红素98μmol/L，甲、乙丙型肝炎病毒学检查均为阴性。经询问，患者服药期间未服用其他药物及保健品，但2年前曾服用过复方青黛胶囊，也曾出现过转氨酶升高的情况。入院对症处理后，症状缓解，复查肝功能：丙氨酸氨基转移酶100U/L，天门冬氨酸氨基转移酶98U/L，总胆红素18μmol/L。执业药师对该患者肝损伤与复方青黛胶囊之间的关联性进行评价，正确的评价结果是肯定相关（B对）。国家药品监督管理局（NMPA）发布的《药品不良反应报告和监测管理办法》将不良反应与药品的关联程度分为六个级别：肯定、很可能、可能、可能无关、待评价、无法评价。其中待评价和无法评价是指因为资料不足，难以评价不良反应与药品之间的关联性。关联性评价标准：①肯定：用药及反应发生时间顺序合理；停药以后反应停止，或迅速减轻或好转（根据机体免疫状态某些ADR反应可出现在停药数天以后）；再次使用，反应再现，并可能明显加重（即激发试验阳性）；同时有文献资料佐证；并已排除原患疾病等其他混杂因素影响。②很可能（D错）：无重复用药史，余同“肯定”或虽然有合并用药，但基本可排除合并用药导致反应发生的可能性。③可能（C错）：用药与反应发生时间关系密切，同时有文献资料佐证；但引发ADR的药品不止一种，或原患疾病病情进展因素不能除外。④可能无关（A错）：ADR与用药时间相关性不密切，反应表现与已知该药ADR不相吻合，原患疾病发展同样可能有类似的临床表现。⑤待评价：报表内容填写不齐全，等待补充后再评价，或因果关系难以定论，缺乏文献资料佐证。⑥无法评价（E错）：报表缺项太多，因果关系难以定论，资料又无法补充。